在成釉器形成的连续三个时期的分化组织描述正确的是
A. 蕾状期：外釉上皮、内釉上皮、星网状层
B. 帽状期：外釉上皮、内釉上皮、星网状层、中间层
C. 钟状期：外釉上皮、内釉上皮、星网状层
D. 蕾状期：外釉上皮、内釉上皮、中间层
E. 钟状期：外釉上皮、内釉上皮、中间层、星网状层

正确答案：E。钟状期：外釉上皮、内釉上皮、中间层、星网状层

解析：成釉器的三个时期：①蕾状期：未见细胞分化；②帽状期：外釉上皮、内釉上皮、星网状层；③钟状期：外釉上皮、内釉上皮、中间层、星网状层。掌握“牙胚的发生及分化”知识点。